注射剂能够用于月经不调，绝经后乳腺癌、子宫内膜癌的药物是
A. 左炔诺孕酮
B. 地屈孕酮
C. 甲羟孕酮
D. 黄体酮
E. 羟孕酮

正确答案：C。甲羟孕酮

解析：本题考查甲羟孕酮剂型及适应症。甲羟孕酮（C对）注射液可用作长效避孕药，亦可用于绝经期后乳腺癌及子宫内膜癌。